第二心音固定分裂，常见于
A. 二尖瓣关闭不全
B. 主动脉瓣关闭不全
C. 肺动脉瓣关闭不全
D. 房间隔缺损
E. 室间隔缺损

正确答案：D。房间隔缺损

解析：第二心音，主要来自于主动脉瓣和肺动脉瓣突然关闭。正常情况下，主动脉瓣和肺动脉瓣关闭的时间间隔较短，不能为人耳分别，听诊为一个声音。当第二心音的主动脉瓣成份与肺动脉瓣成份之间的间距延长，导致听诊为两个声音，即称为第二心音分裂。房间隔缺损（D对）时，第二心音分裂属于固定分裂。虽然呼气时右心房回心血量有所减少，但由于存在左房向右房的血液分流，右心血流仍然增加，排血时间延长，肺动脉瓣关闭明显延迟，致S₂分裂；当吸气时，回心血流增加，但右房压力暂时性增高同时造成左向右分流稍减，抵消了吸气导致的右心血流增加的改变，因此其S₂分裂的时距较固定。二尖瓣关闭不全（A错）最主要的体征是心尖部收缩期杂音，第一心音减弱。主动脉瓣关闭不全（B错）最主要的体征是主动脉瓣区舒张期吹风样杂音，第二心音减弱。肺动脉瓣关闭不全（C错）常于肺动脉听诊区听到舒张期杂音。室间隔缺损（E错）有左到右分流，可在胸骨左缘闻及收缩期杂音。